正常婴儿，体重7.2kg，能独坐一会儿，能用手摇玩具，最可能的年龄是
A. 4个月
B. 5个月
C. 6个月
D. 7个月
E. 8个月

正确答案：C。6个月

解析：2个月开始抬头；4个月手能握持玩具；5个月扶腋下能站得直，两手各握一玩具；6个月能独坐一会儿，用手摇玩具；7个月会翻身，独坐很久，将玩具换手；8个月会爬，会拍手及扶栏杆站起。掌握“运动和语言发育”知识点。